适宜于大部分腧穴的进针角度是
A. 直刺
B. 斜刺
C. 平刺
D. 横刺
E. 沿皮刺

正确答案：A。直刺

解析：直刺法（A对）是指与皮肤表面呈90°左右垂直刺入。此法适用于人体大部分腧穴；斜刺法（B错）是指与皮肤表面呈45°左右倾斜刺入。此法用于肌肉浅薄处或内有重要脏器处；平刺（C错），又称横刺（D错）、或者沿皮刺（E错），是指与皮肤表面呈15°左右沿皮刺入，主要用于皮薄肉少部位的腧穴。